支气管哮喘的临床症状描述正确的是
A. 吸气性呼吸困难
B. 发作性胸闷和咳嗽
C. 发作欺无哮鸣音
D. 正午出现剧烈发作
E. 使用支气管舒张药无效

正确答案：B。发作性胸闷和咳嗽

解析：支气管哮喘症状：发作性伴有哮鸣音的呼气性呼吸困难或发作性胸闷和咳嗽是哮喘的主要症状，其症状特点表现为常在夜间及凌晨发作和加重，可在数分钟内发作，经数小时至数天。用支气管舒张药后或自行缓解。咳嗽变异型哮喘患者则仅表现为咳嗽。运动性哮喘则多在运动后出现胸闷、咳嗽和呼吸困难。掌握“支气管哮喘”知识点。